治疗休息痢日久，脾阳极虚，肠中寒积不化，遇寒即发者，应首选
A. 连理汤
B. 半夏泻心汤
C. 乌梅丸
D. 左金丸
E. 温脾汤

正确答案：E。温脾汤

解析：温脾汤功能攻下冷积，温补脾阳，休息痢见脾阳虚极，肠中寒积不化时首选（E对）。连理汤功能温中补脾兼清湿热，为治疗痢疾休息痢的选方（A错）。半夏泻心汤功能辛开苦降，寒热并调，为治疗胃痛寒邪客胃证的选方（B错）。乌梅丸功能温脏安蛔，为治疗胁痛肝胆湿热证胁肋剧痛，呕吐蛔虫者，可先以乌梅丸安蛔，再予驱蛔（C错）。左金丸功能清泻肝火，降逆止呕，为治疗呕吐之肝气犯胃证的选方（D错）。